疮疡内治，清血分热之常用方剂是
A. 五味消毒饮
B. 仙方活命饮
C. 黄连解毒汤
D. 犀角地黄汤
E. 清骨散

正确答案：D。犀角地黄汤

解析：五味消毒饮为清热解毒方（A错）。仙方活命饮为清热解毒方（B错）。黄连解毒汤为清气分热之方（C错）。犀角地黄汤为清血分热之方（D对）。清骨散为除骨蒸潮热方（E错）。